恶性黑色素瘤的治疗原则的论述中，不正确的是
A. 放射治疗为主
B. 不宜行活组织检查
C. 恶性黑色素瘤转移率较高
D. 应施行选择性颈淋巴清扫术
E. 手术为主，但必须作广泛、彻底切除

正确答案：A。放射治疗为主

解析：以外科手术切除为主。对放射治疗不敏感。手术原则必须作广泛彻底切除，切除范围要比其他恶性肿瘤更广、更深。由于恶性黑色素瘤早期就有区域区淋巴结转移，且转移率较高，因此应施行选择性颈淋巴清扫术。掌握“恶性黑色素瘤”知识点。